女性，25岁。人流术后2周，腹痛伴高热，阴道分泌物增多，大便里急后重。妇科检查：宫颈管内可见大量脓性分泌物。宫颈举痛。子宫前位，饱满，质中等，活动不良，压痛明显，附件增厚，下腹压痛，反跳痛，及肌紧张阳性。查体：体温38.5度。下一步治疗应选择
A. 手术切除子宫
B. 抗生素口服
C. 抗生素静滴
D. 利福平，异烟肼联合应用9个月
E. 链霉素肌注半年

正确答案：C。抗生素静滴

解析：患者为青年女性，人流术后2周（盆腔炎多见于15～25岁年轻妇女，子宫腔内手术操作如刮宫术后易感染），出现腹痛、高热、阴道分泌物增多、里急后重（病情严重者可有高热，当有腹膜炎并扩展到腹膜外时出现腹泻、里急后重感），妇检：宫颈管内可见大量脓性分泌物；宫颈举痛、子宫活动不良、压痛明显、附件增厚、下腹有腹膜刺激征（妇检时可发现患者宫颈举痛，宫体饱满、压痛明显且活动不良及受累的附件区增厚），最可能的诊断是急性盆腔腹膜炎。该患者病情严重，下一步治疗应选用收效快的抗生素静滴（C对B错）。手术切除子宫（P263）（A错）主要适用于年龄大、双侧附件受累或附件脓肿屡次发作者。利福平、异烟肼（D错）及链霉素（E错）是治疗生殖器官结核的常用药物。